喉位于颈前部中份，以软骨为支架，各软骨借关节、韧带及纤维膜相连接，内衬黏膜，并有喉肌附着。喉既是呼吸道，又是发音器官。喉的内腔为喉腔，向上通咽，向下通气管。环杓关节的作用是
A. 开大喉口
B. 缩小喉口
C. 使声带紧张或松弛
D. 使声门裂开大或缩小
E. 紧张弹性圆锥

正确答案：D。使声门裂开大或缩小

解析：环杓关节的作用是使声门裂开大或缩小（D对）。